能沿浓度梯度扩散，需要载体参加但不消耗能量的转运方式称为
A. 简单扩散
B. 主动转运
C. 易化扩散
D. 滤过

正确答案：C。易化扩散

解析：本题考查化学毒物通过生物膜的方式。能沿浓度梯度扩散，需要载体参加但不消耗能量的转运方式称为易化扩散（C对ABD错）。